女性的基础体温在排卵后可升高。这种基础体温的升高与哪种激素有关
A. 孕激素
B. 雌激素
C. 甲状腺素
D. 黄体生成素
E. 卵泡刺激素

正确答案：A。孕激素